65岁女性，全口多数牙缺失，仅余留左上78，且松动Ⅲ°，牙龈红肿，牙槽嵴高度适中，颌间距离正常。修复前应做的工作是拔除左上78。拟采用的修复方法是全口义齿修复。若按正确的方法修复，制取印模的方式为
A. 上下颌均取功能性印模
B. 上下颌均取解剖式印模
C. 上颌取功能性印模，下颌取解剖式印模
D. 上颌取解剖式印模，下颌取功能性印模
E. 以上均可

正确答案：A。上下颌均取功能性印模

解析：本题考查全口义齿印模的选择。全口义齿制作要制取功能性印模（A对）。功能性印模又称为选择性压力印模，是在软组织受到功能性压力变形状态下的印模，对印模范围内的不同区域采取不同的压力，适当减小缓冲区的压力。解剖式印模（BCD错）是在承托义齿的软硬组织处于非功能状态下取得的印模，为无压力印模，通常用流动性较好的印模材料制取，它可以准确地印记牙和牙槽嵴的解剖形态，据此所做的义齿对牙和所接触的其他组织皆不产生压力，对牙支持式和黏膜支持式义齿都可以采取这种印模。